某女，85岁。一年来，因肝肾阴虚导致眩晕耳鸣，羞明畏光，迎风流泪昏花。宜选用的成药是
A. 黄连羊肝丸
B. 大补阴丸
C. 明目蒺藜丸
D. 六味地黄丸
E. 杞菊地黄丸

正确答案：E。杞菊地黄丸

解析：本题考查的是杞菊地黄丸的主治。一年来，因肝肾阴虚导致眩晕耳鸣，羞明畏光，迎风流泪昏花。宜选用的成药是杞菊地黄丸（E对）。杞菊地黄丸：【主治】肝肾阴亏，眩晕耳鸣，羞明畏光，迎风流泪，视物昏花。黄连羊肝丸（A错）：【主治】肝火旺盛所致的目赤肿痛，视物昏暗，羞明流泪，胬肉攀睛。大补阴丸（B错）：【主治】阴虚火旺，潮热盗汗，咳嗽咯血，耳鸣遗精。明目蒺藜丸（C错）：【主治】上焦火盛引起的暴发火眼、云蒙障翳、羞明多眵、眼边赤烂、红肿痛痒、迎风流泪。六味地黄丸（D错）：【主治】肾阴亏损，头晕耳鸣，腰膝酸软，骨蒸潮热，盗汗遗精，消渴。